内囊通过的纤维
A. 后肢有皮质脊髓束、丘脑皮质束、听、视辐射
B. 前肢有皮质脑干束
C. 膝部有丘脑上辐射通过
D. 额桥束纤维通过后脚
E. 以上都不对

正确答案：A。后肢有皮质脊髓束、丘脑皮质束、听、视辐射

解析：内囊是位于丘脑、尾状核和豆状核之间的白质板，分前肢、膝、后肢三部。经内囊前肢（B错）的投射纤维有额桥束、丘脑前辐射；经内囊膝部（C错）的投射纤维有皮质核束；经内囊后肢（A对D错）的投射纤维有皮质脊髓束、丘脑皮质束、听辐射、视辐射等。